患儿，男，12岁。1天前参加同学聚会，暴饮暴食，食后脘腹胀痛现呕吐酸腐食物，口臭，大便臭秽，舌苔厚腻，脉滑有力宜诊断为
A. 胃火炽盛
B. 脾胃虚弱
C. 肝火犯胃
D. 食滞胃脘
E. 肠道湿热

正确答案：D。食滞胃脘

解析：患者以脘腹胀痛、呕吐为主诉，故判断病位在胃。食积胃脘，胃失和降，气机不畅，故胃脘胀满疼痛、拒按；胃失和降，胃气上逆，胃气夹积食、浊气上逆，则嗳腐吞酸，或呕吐酸馊食物；腐败食物下注，泻下之物酸腐臭秽；胃中腐浊之气上蒸，口臭，舌苔厚腻；脉滑，为食积之象；故诊断为食滞胃脘证（D对）。胃火炽盛证，临床表现为胃脘灼痛、拒按，消谷善饥，口气臭秽，齿龈红肿疼痛，甚则化脓、溃烂，或见齿衄，渴喜冷饮，大便秘结，小便短黄，舌红苔黄，脉滑数（A错）。脾胃虚弱证，临床表现为食入即吐，口淡无味，时时呕吐清涎，脘痞腹胀，倦怠嗜卧，舌淡，苔白润，脉缓滑无力（B错）。肝火犯胃证，临床表现为吐血色红或紫黯，口苦胁痛，心烦易怒，寐少梦多，舌质红绛，脉弦数（C错）。肠道湿热证，临床表现为腹痛，腹泻，肛门灼热，或暴注下泻，色黄味臭；或下痢赤白脓血，里急后重，口渴，小便短赤，或伴恶寒发热，或但热不寒；舌红苔黄腻，脉滑数或濡数（E错）。